铅环境作业的职业禁忌症不包括
A. 周围神经炎
B. 哮喘
C. 贫血
D. 卟啉病

正确答案：B。哮喘

解析：本题考查铅作业的职业禁忌症。铅作业的职业禁忌证包括：贫血（C对）、卟啉病（D对）及多发性周围神经炎（A对）。哮喘（B错，为本题正确答案）不是铅作业的职业禁忌症。